可用于粉末直接压片的助流剂是
A. 甲基纤维素钠
B. 糖粉
C. 微粉硅胶
D. 交联聚乙烯吡咯烷酮
E. 聚乙烯醇

正确答案：C。微粉硅胶

解析：本题考查片剂的辅料。微粉硅胶（C对）可用作粉末直接压片的助流剂，助流剂是降低颗粒之间摩擦力，从而改善粉体流动性，减少重量差异。